患者高某，男，63岁。发热恶寒，头沉微痛，胸膈满闷，恶心呕吐，肠鸣泄泻，舌苔白腻，脉濡缓。治宜选用
A. 九味羌活汤
B. 三仁汤
C. 羌活胜湿汤
D. 平胃散
E. 藿香正气散

正确答案：E。藿香正气散

解析：题中患者以发热恶寒为主，诊断为感冒。风寒束表，腠理闭塞，肺气不宣，则头沉微痛，胸膈满闷；寒湿内盛，脾失健运，疏泻失常，则恶心呕吐，肠鸣泄泻；湿邪为患，则舌苔白腻，脉濡缓，故属于暑湿感冒，治疗应用芳香化湿，解表散寒的藿香正气散（E对）。九味羌活汤发汗祛湿，兼清里热，主治外感风寒湿邪，内有蕴热证（A错）。三仁汤清热利湿，宣畅湿浊，主治湿温初起（B错）。羌活胜湿汤祛风胜湿，主治风湿在表之痹症（C错）。平胃散燥湿运脾，行气和胃，主治由痰湿留滞或山岚瘴气或水土不服所致的脾胃不和（D错）。